关于经济因素对健康的影响，不正确的说法是
A. 经济因素对健康的影响是多方面的
B. 经济的发展应与社会发展及促进人群健康水平同步
C. 人群收入的绝对水平决定着经济对健康的影响程度
D. 单纯注重经济增长将危害人类的健康
E. 人群的健康水平影响经济的发展

正确答案：C。人群收入的绝对水平决定着经济对健康的影响程度

解析：经济因素对健康的影响程度是由多方面的共同影响（A对），但人群收入的绝对水平并不能决定经济对健康的影响程度（C错，为本题正确答案），单纯注重经济增长将危害人类的健康（D对）。经济的发展应与社会发展及促进入群健康水平同步（B对），如若不然，就会出现医疗设施满足不了人类健康的需要，导致疾病的发生、发展。相反，人群的健康水平影响经济的发展（E对）。